女，28岁。妊娠2个月，到某大学附属医院妇产科接受人工流产手术。接诊医师在给患者检查时，旁边有10多位男女见习医学生。患者要求见习医学生出去，被接诊医师拒绝，随后医师边操作边给医学生讲解。术后患者质问医师为何示教未事先告知，医师认为患者在医院无隐私，后患者以隐私权被侵犯为由，要求当地卫生行政部门进行处理。基于该案例，卫生行政部门给予当事医师警告处分。处分的依据是
A. 医师法
B. 药品管理法
C. 行政处罚法
D. 母婴保健法
E. 精神卫生法

正确答案：A。医师法

解析：《医师法》规定，医师在执业活动中应当履行“关心、爱护、尊重患者，保护患者的隐私”的义务。该医师未事先告知患者，并拒绝患者让见习医学生出去的要求，并边操作边给医学生讲解。该行为侵犯了患者的隐私权。卫生行政部门给予当事医师警告处分的依据是执业医师法（A对）。